病例对照研究的主要偏倚是
A. 选择偏倚
B. 回忆偏倚
C. 测量偏倚
D. 失访偏倚
E. 随意误差

正确答案：B。回忆偏倚

解析：本题考查病例对照研究的主要偏倚。回忆偏倚是由于研究对象对暴露史或既往史回忆的准确性和完整性存在系统误差而引起的偏倚。由于病例对照研究主要是调查研究对象既往的暴露情况，因此回忆偏倚（B对ACDE错）是病例对照研究中最常见的信息偏倚。